引起菌群失调症的原因是
A. 正常菌群的遗传特性明显改变
B. 正常菌群的耐药性明显改变
C. 正常菌群的增殖方式明显改变
D. 正常菌群的组成和数量明显改变
E. 大量使用生态制剂

正确答案：D。正常菌群的组成和数量明显改变